患儿，9岁。水肿从眼睑开始，迅速波及全身，皮肤光亮，按之凹陷即起，尿少色赤，伴咽红肿痛，肢体酸痛，苔薄白，脉浮。其治法是
A. 疏风宣肺，利水消肿
B. 清热利湿，凉血止血
C. 清热解毒，淡渗利湿
D. 温运中阳，行气利水
E. 滋阴补肾，淡渗利水

正确答案：A。疏风宣肺，利水消肿

解析：题中患儿以水肿从眼睑开始，迅速波及全身为主症，诊断为水肿，患儿咽红肿痛，肢体酸痛为伴有外感风邪之证。风性向上，善行而数变，故水肿从眼睑开始，迅速波及全身，来势迅速，皮肤光亮，按之凹陷即起为风水之象，肺失通调，水聚肌肤则尿少，风加湿热蕴结下焦，邪伤血络，故尿色赤。咽红肿痛，肢体酸痛，苔薄白，脉浮为风邪之征。故辨为风水相搏证，治宜疏风宣肺，利水消肿（A对）。清利湿热，凉血止血为小儿急性肾小球肾炎湿热内侵证的治法（B错）。题中患儿无湿热之象（C错）。题中患儿无中阳不足之象（D错）。题中患儿无肾阴虚之象（E错）。